流行病学实验研究与队列研究的主要相同点是
A. 均是分析性研究
B. 均是前瞻性研究
C. 均是回顾性研究
D. 均是实验性研究
E. 均是描述性研究

正确答案：B。均是前瞻性研究